大网膜的错误描述是
A. 前两层附于胃大弯
B. 有防御功能
C. 内有胃左、右动脉
D. 后两层上达横结肠
E. 小儿大网膜较短

正确答案：C。内有胃左、右动脉

解析：大网膜前两层附于胃大弯（A对）和横结肠之间形成胃结肠韧带，后两层上达横结肠（D对）并叠合成横结肠系膜，大网膜内含有巨噬细胞,有重要的防御功能（B对），小儿大网膜较短（E对），胃左、右动脉（C错，为本题正确答案）在肝胃韧带两层之间走行，属于小网膜内的结构。